属于正细胞正色素性贫血的疾病是
A. 缺铁性贫血
B. 急性溶血性贫血
C. 地中海贫血
D. 慢性失血性贫血
E. 营养性巨幼细胞性贫血

正确答案：B。急性溶血性贫血

解析：属于正细胞正色素性贫血的疾病是急性溶血性贫血（B对）。缺铁性贫血（A错）属于小细胞低色素性贫血；地中海贫血（C错）又称珠蛋白合成障碍性贫血属于小细胞低色素性贫血；慢性失血性贫血（D错）往往合并缺铁性贫血（P538）一般为小细胞低色素性贫血；营养性巨幼细胞性贫血（E错）属于大细胞性贫血。